关于药动学参数说法，错误的是
A. 消除速率常数越大，药物体内的消除越快
B. 生物半衰期短的药物，从体内消除较快
C. 符合线性动力学
D. 水溶性或者极性大的药物溶解度好，因此血药浓度高，表观分布容积大
E. 消除率是指单位时间从体内消除的含药血浆体积

正确答案：D。水溶性或者极性大的药物溶解度好，因此血药浓度高，表观分布容积大

解析：本题考查药动学基本概念、参数及临床意义。水溶性大或极性大的药物，不易进入细胞内或脂肪组织中，血药浓度较高，表观分布容积较小（D错，为本题正确答案）。